在国家一级保护野生药材物种范围内的药材是
A. 羚羊角
B. 甘草
C. 人参
D. 黄柏
E. 防风

正确答案：A。羚羊角

解析：本题考查一级保护野生药材物种。在国家一级保护野生药材物种范围内的药材是羚羊角（A对）。一级保护野生药材物种系指濒临灭绝状态的稀有珍贵野生药材物种。一级保护药材名称：虎骨、豹骨、羚羊角、鹿茸（梅花鹿）。二级保护野生药材物种系指分布区域缩小、资源处于衰竭状态的重要野生药材物种。二级保护药材名称：鹿茸（马鹿）、麝香（3个品种）、熊胆（2个品种）、穿山甲、蟾酥（2个品种）、哈蟆油、金钱白花蛇、乌梢蛇、蛤蚧、甘草（3个品种）（B错）、黄连（3个品种）、人参（C错）、杜仲、厚朴（2个品种）、黄柏（2个品种）（D错）、血竭。三级保护野生药材物种系指资源严重减少的主要常用野生药材物种。三级保护药材名称：川贝母（4个品种）、伊贝母（2个品种）、刺五加、黄芩、天冬、猪苓、龙胆（4个品种）、防风（E错）、远志（2个品种）、胡黄连、肉从蓉、秦艽（4个品种）、细辛（3个品种）、紫草、五味子（2个品种）、蔓荆子（2个品种）、诃子（2个品种）、山茱萸、石斛（5个品种）、阿魏（2个品种）、连翘（2个品种）、羌活（2个品种）。